某人的血浆中只含有抗A凝集素，则该人的血型可能是
A. A型
B. B型
C. O型
D. AB型
E. Rh型

正确答案：B。B型